提出“人命至重，有贵千金，一方济之，德逾于此”观点的是
A. 孙思邈
B. 扁鹊
C. 李时珍
D. 华佗
E. 张仲景

正确答案：A。孙思邈

解析：“人命至重，有贵千金，一方济之，德逾于此”这句名言是由唐代的药王孙思邈提出的（A对）。